大补阴丸治疗
A. 风热伤络证
B. 血热妄行证
C. 气不摄血证
D. 阴虚火旺证
E. 气滞血瘀证

正确答案：D。阴虚火旺证

解析：大补阴丸方证主要是由肝肾亏虚，真阴不足，虚火上炎所致，功用滋阴降火，主治阴虚火旺证，为治疗阴虚火旺证的基础方（D对）。